与肿瘤免疫逃逸无关的因素是
A. 肿瘤细胞缺少共刺激信号
B. 肿瘤细胞MHC分子表达下调
C. 不能诱导有效抗体应答
D. 肿瘤相关抗原免疫性弱
E. 肿瘤细胞分泌抑制性细胞因子

正确答案：C。不能诱导有效抗体应答

解析：肿瘤免疫逃逸是指肿瘤细胞通过多种机制逃避机体免疫系统识别和攻击，从而得以在体内生存和增殖的现象。其相关因素有肿瘤细胞的抗原缺失和抗原调变（D对）、肿瘤细胞MHCⅠ类分子表达低下（B对）、肿瘤细胞共刺激信号异常（A对）、肿瘤细胞表达或分泌免疫抑制分子（E对）、肿瘤细胞的抗凋亡作用 、某些肿瘤细胞表面可表达Fasl和抑制性分子，诱导肿瘤特异性T细胞凋亡和抑制T细胞的活化与增殖 、肿瘤细胞还可以通过主动诱导荷瘤机体产生Treg和髓源性抑制细胞抑制机体免疫应答（C错，为此题正确答案）。